符合颌面部闭合性损伤特点的是
A. 出血量较多
B. 深层组织易发生感染
C. 常有淤斑和血肿形成
D. 可能有较多的异物存留
E. 因组织缺损导致面部畸形

正确答案：C。常有淤斑和血肿形成

解析：本题考查颌面部闭合性损伤的特点。口腔颌面部损伤分为开放性损伤和闭合性损伤。由于口腔颌面部血液循环丰富，因此，颌面部闭合性损伤常有淤斑和血肿形成（C对）。出血量较多（A错）、因组织缺损导致面部畸形（E错）一般为开放性损伤特点。刺、割伤、爆炸伤等属于开放性损伤，刺伤时可将沙土和细菌带入伤口深处，深层组织易发生感染（B错），爆炸伤时，可能有较多的异物存留（D错）。